人血浆内蛋白质总浓度大约为
A. 40～55g/L
B. 50～55g/L
C. 55～60g/L
D. 70～75g/L
E. 75～90g/L

正确答案：D。70～75g/L

解析：人血浆内蛋白质总浓度大约为70～75g/L，它们是血浆主要的固体成分。掌握“血液成分及血浆蛋白”知识点。